匹配过头指匹配的变量太多
A. 难以获得对照
B. 造成分析困难
C. 使病例和对照的人数都减少
D. 将不起混杂作用的因素当作匹配因素
E. 将无关变量列入了匹配因子

正确答案：D。将不起混杂作用的因素当作匹配因素

解析：本题考查匹配过头的概念。匹配过头是指把不起混杂作用的因素（包括疾病的危险因子（D对ABCE错））作为匹配变量进行匹配，试图使对照组与病例组在多方面都一致，结果导致所研究的因素也趋于一致，结果反而降低了研究效率。